骨折急救处理中不正确的是
A. 包扎伤口
B. 妥善的外固定
C. 首先抢救生命
D. 外露的骨折端立即复位
E. 迅速运往医院

正确答案：D。外露的骨折端立即复位

解析：对于骨折端外露的开放性骨折，如果未压迫重要血管神经，不应将其复位，以免将污染物带到伤口深处（D错，为本题正确答案），骨折的复位应当在对污染的创口行清创处理后进行。骨折急救的目的是用最为简单而有效的方法抢救生命（C对），主要是抢救休克；包扎伤口（A对）、妥善的外固定（B对）、迅速运往医院（E对）均是骨折的急救措施。